以疾病特性命名的是
A. 发
B. 背疽
C. 肠痈
D. 烂疔
E. 委中毒

正确答案：D。烂疔

解析：本题考查疾病的命名原则。外科命名一般是依据部位、穴位、脏腑、病因、症状、形态、颜色、疾病特性、范围大小等分别加以命名的。以疾病特性命名的：如烂疔、流注、湿疮等（D对）。发是以范围大小命名的：如小的为疖，大的为痈，更大的为发（A错）。背疽是以部位命名的（B错）。肠痈是以脏腑命名的（C错）。委中毒以穴位命名的，委中穴位于腘窝（E错）。